季铵化合物漱口剂常用的浓度为
A. 0.0001
B. 0.0005
C. 0.005
D. 0.01
E. 0.02

正确答案：B。0.0005

解析：一般以0.05%的浓度作为漱口剂，可抑制菌斑的形成和牙龈炎的发生。掌握“菌斑控制及提高宿主抵抗力”知识点。